下列哪项不是流行病学实验研究的缺点
A. 设计和实验条件高、控制严、难度大
B. 易失访
C. 依从性不易做得很好
D. 论证强度不如分析性研究
E. 花费人力、物力、财力，有时还会涉及医德问题

正确答案：D。论证强度不如分析性研究